女，55岁，间断上腹部隐痛1年，消瘦半年，Hb59g/L，WBC6.8×10⁹/L，plt160×10⁹/L，胃镜检查提示胃癌，拟行胃癌根治术，完善术前输血相关血清学检查，不包括
A. Rh血型鉴定
B. ABO血型鉴定
C. 交叉配血试验
D. 血小板抗体筛查
E. 不规则抗体筛查

正确答案：D。血小板抗体筛查

解析：女，55岁，间断上腹部隐痛1年，消瘦半年，Hb59g/L（血红蛋白正常值为110-150g/L，患者Hb低于正常值），WBC6.8×10⁹/L（白细胞正常值为(4-10)×10⁹/L，患者白细胞正常），plt160×10⁹/L(血小板的正常值为(100~300)×10⁹/L，患者血小板正常），胃镜检查提示胃癌，拟行胃癌根治术，完善术前输血相关血清学检查，它包括血型鉴定和交叉配合试验，不规则抗体是指除A、B、O血型系统的抗A、抗B、抗D以外的其它抗体，包括Rh系统的抗D抗体。做不规则抗体筛查可防止出现溶血（E对）。血小板抗体检查主要用于出血性疾病的检查，不属于术前输血相关血清学检查（D错，为本题正确答案）。